具有安神功效的药物是
A. 朱砂
B. 磁石
C. 二者均是
D. 二者均不是

正确答案：C。二者均是

解析：本题考查的是朱砂与磁石的功效。具有安神功效的药物是朱砂与磁石（C对）。朱砂（A错）：【功效】镇心安神，清热解毒。磁石（B错）：【功效】镇惊安神，平肝潜阳，聪耳明目，纳气平喘。